男，22岁。咳嗽伴发热3天，给予青霉素静滴抗感染治疗，用药后患者突然出现气急胸闷烦躁不安。查体：T38.5℃，P140次/分，R37次/分，BP75/40mmHg，面色苍白，大汗淋漓。两肺可闻及喘鸣音。身体多部位红色皮疹。最可能的原因是
A. 急性左心衰竭
B. 哮喘急性发作
C. 过敏性休克
D. 急性呼吸窘迫综合征
E. 感染性休克

正确答案：C。过敏性休克

解析：患者在静滴青霉素后，出现出现气急、胸闷、烦躁不安的症状，BP75／40mmHg（已处于休克的状态，出现循环衰竭的表现），且身体多部位红色皮疹（青霉素的变态反应中，可出现药疹），考虑该患者的诊断是青霉素过敏导致的过敏性休克（C对）。急性左心衰竭（A错）多见于有心脏基础疾病的中老年患者，可出现特征性的粉红色泡沫状痰。哮喘急性发病（B错）表现为呼气性呼吸困难，身体不会出现红色皮疹。急性呼吸窘迫综合征（D错）常有致病的危险因素，如创伤、手术、溺水史，有难以纠正的低氧血症，身体也不会出现红色皮疹。感染性休克（E错）的患者，在经过抗感染治疗后，病情往往可以好转，该例患者在经过抗感染治疗之后，出现症状加剧的表现。